下利清谷，里寒外热，汗出而厥者，治宜选用
A. 四逆散
B. 茯苓四逆汤
C. 通脉四逆汤
D. 四逆汤
E. 白通汤

正确答案：C。通脉四逆汤

解析：下利清谷，手足厥逆，脉微，为少阴寒化证典型脉症，在此基础上，若见脉微欲绝，则提示此证非一般性少阴寒化证，而是真阳衰竭之危候。阳气极虚，阴寒内盛、病生格拒之变，阴盛格阳，虚阳外浮，则身反不恶寒。虚阳上浮则面色赤，特点为嫩红色，且游移不定，与属热属实的阳明病“面合色赤”及二阳并病的“面色缘缘正赤”而不游移截然不同。本证为阴盛格阳证。论中所云“里寒外热”实指内真寒外假热。由于阴阳格拒证势危重，复杂多变，故除主症外，又多有或然症；阴寒凝结，脾络不通则腹痛；阴寒犯胃，胃失和降，胃气上逆则干呕；虚阳上浮，扰及咽部则咽痛；阳气欲绝，下利至甚，无物可下，阴液将竭则利止脉不出。此证较四逆汤证危重，如进一步发展则会阴阳离决，已非四逆汤所能胜任，需大力回阳，急驱内寒，故用通脉四逆汤破阴回阳，通达内外（C对）。